浸润黏膜固有层的膀胱肿瘤的分期是
A. Tₐ
B. T₁
C. T₂
D. T₃
E. T₄

正确答案：B。T₁